咀嚼效率是指
A. 在一定时间内咀嚼磨细食物的数量
B. 咀嚼磨细一定量食物所需要的时间
C. 在一定时间内的食物咀嚼磨细的程度
D. 在一定时间内对定量食物咀嚼磨细的程度
E. 咀嚼磨细食物的能力

正确答案：D。在一定时间内对定量食物咀嚼磨细的程度

解析：本题考查咀嚼效率。咀嚼效率是指在一定时间内对定量食物咀嚼磨细的程度（D对）。咀嚼的主要功能之一是粉碎食物，使其能被吞咽和消化。机体在一定时间内，对定量食物嚼细的程度，称为咀嚼效率。咀嚼效率是咀嚼作用的实际效果，也是衡量咀嚼能力大小的一个重要生理指标。